牙周疾病与全身疾病和健康无关的是
A. 早产
B. 类风湿关节炎
C. 胃幽门螺杆菌
D. 上呼吸道感染
E. 心脑血管疾病

正确答案：D。上呼吸道感染

解析：本题考查牙周疾病与全身疾病和健康的关系。牙周疾病与全身疾病和健康无关的是上呼吸道感染（D错，为本题正确答案）。牙周疾病与全身疾病和健康有关，主要表现在心脑血管疾病（E对）、糖尿病、早产（A对）和低出生体重儿、口腔幽门螺杆菌和胃幽门螺杆菌（C对）、类风湿关节炎（B对）。